不属于社区牙周指数检查方法描述的是
A. 每个区段内必须有2颗或2颗以上功能牙
B. 缺失一颗指数牙或有拔牙指征，则只检查另一颗指数牙
C. 一个区段内有拔牙指征，则该区段不检查，记为X
D. 每个区段两颗功能牙检查结果，以最重情况记分
E. 6个区段中最高的记分作为个人CPI值

正确答案：C。一个区段内有拔牙指征，则该区段不检查，记为X

解析：WHO规定，每个区段内必须有2颗或2颗以上功能牙，并且无拔牙指征，该区段才做检查。成年人的后牙区段，有时缺失一颗指数牙或有拔牙指征，则只检查另一颗指数牙。如果一个区段内的指数牙全部缺失或有拔牙指征时，则检查此区段内的所有其余牙，以最重情况记分。每颗指数牙的所有龈沟或牙周袋都须检查到。每个区段两颗功能牙检查结果，以最重情况记分。以6个区段中最高的记分作为个人CPI值。掌握“牙周病流行病学及分级预防”知识点。